下列哪种不是AFB在体内羟化的代谢产物
A. AFM₁
B. AFQ₁
C. AFP₁
D. AFH₁
E. AF毒醇

正确答案：C。AFP₁